《素问·痹论》指出，肾痹的症状是
A. 夜卧则惊，多饮数小便
B. 善胀，尻以代蹱，脊以代头
C. 烦满而呕
D. 中气喘争时发飧泄
E. 四支解堕，发咳呕汁

正确答案：B。善胀，尻以代蹱，脊以代头

解析：肾痹者，善胀，尻以代踵，脊以代头（B对）。夜卧则惊，多饮数小便是肝痹的症状（A错）。烦满而呕是肺痹的症状（C错）。中气喘争时发飧泄是肠痹的症状（D错）。四支解堕，发咳呕汁是脾痹的症状（E错）。